管理瞳孔的肌是
A. 提上睑肌
B. 上直肌
C. 瞳孔括约肌
D. 内直肌
E. 睫状肌

正确答案：C。瞳孔括约肌

解析：瞳孔括约肌（C对）收缩使瞳孔缩小，即管理瞳孔；提上睑肌（上睑提肌）（A错）收缩提上睑，开大眼裂；上直肌（B错）收缩使瞳孔转向上内；内直肌（D错）收缩使瞳孔转向内侧；睫状肌（E错）调节晶状体的曲度。